男，52岁。头颈部、双上肢浅Ⅱ°烧伤。伤后第3天出现黑便，量约700ml。查体：P107次/分，BP85/60mmHg。最可能的原因是
A. 胆道出血
B. 消化性溃疡出血
C. 慢性胃炎出血
D. 食管溃疡出血
E. 应激性溃疡出血

正确答案：E。应激性溃疡出血

解析：患者为中年男性，严重烧伤（头颈部、双上肢浅Ⅱ°烧伤属中度烧伤）后3天出现黑便（提示消化道出血），血压85/60mmHg（提示出现休克）。根据病史、查体，考虑为严重烧伤后引起的应激性溃疡出血，进一步引发休克（E对）。广泛深度烧伤时，交感神经兴奋，肾上腺髓质分泌儿茶酚胺增多，使胃黏膜下血管发生挛缩性收缩，组织灌流量显著下降，导致胃粘膜缺血、缺氧，以至于发生表浅的、边缘平坦的溃疡或大小不等的糜烂灶，导致上消化道大出血。胆道出血（A错）多为周期性，且出血量一般在200～300ml之间。消化性溃疡出血（B错）多有溃疡病病史，与烧伤无关。慢性胃炎（C错）消化道症状不多，一般不引起出血。食管溃疡出血（D错）多与胃食管反流病相关，应有胃食管反流病病史。